肝性脑病患者可采取下列何种溶液灌肠
A. 肥皂水
B. 稀醋酸液
C. 地塞米松
D. 谷氨酸钾
E. 精氨酸

正确答案：B。稀醋酸液

解析：氨代谢紊乱引起氨中毒是肝性脑病、特别是门-体分流性肝性脑病的重要发病机制。消化道是产氨的主要部位。NH₃和NH₄⁺在体内可受pH梯度的影响而相互转化（NH₃+H⁺⇌NH₄⁺）：NH₃在酸性环境中，与H⁺结合形成毒性小的NH₄⁺，随粪便排出体外；在碱性环境中，NH₄⁺ 解离为NH₃和H⁺，NH₃大量弥散入血，导致肝性脑病。肝性脑病的患者应采用弱酸灌肠，以促进氨的排出，目前多采用醋酸（B对）灌肠。肥皂水（A错）多为碱性溶液，灌肠后更易诱发肝性脑病。地塞米松（C错）为抗炎药，对肝性脑病患者肠道酸碱度无影响。谷氨酸钾（D错）、精氨酸（E错）均为静脉注射剂，一般不用于灌肠。